女，45岁。颈肩痛伴左上肢放射痛1周。查体：Eaton试验（＋）。颈部MRI显示C₅₋₆，C₆₋₇椎间盘向左后突出8mm，关节突增生。颈椎斜位X线检查显示C₅₋₆椎间孔稍变窄。首选的治疗措施是
A. 颈横肌锻炼
B. 椎板切除减压术
C. 前路椎间盘切除
D. 后路椎间盘切除
E. 颌枕吊带牵引

正确答案：E。颌枕吊带牵引

解析：中年女性患者，有颈肩痛伴左上肢放射痛（表明颈神经根受压迫），颈部MRI显示C₅-₆，C₆-₇椎间盘向左后突出，可诊断为颈椎间盘突出症，其治疗先采用非手术治疗，如颌枕吊带牵引（E对）、休息、卧床等。颈椎间盘突出症不适用颈横肌锻炼（A错）。椎板切除减压术（B错）、前路椎间盘切除（C错）、后路椎间盘切除（D错）适用于非手术治疗无效，疼痛加重，甚至出现肌肉瘫痪等症状时，不作为首选。